男，30岁。约1年时间孤僻、寡言，近期由于被上级批评后出现失眠，不上班并紧闭门窗，声称有人监视自己，在家中不敢谈话，说家中已被安装窃听器，公安局也要逮捕自己，不吃妻子做的饭食，认为妻子已同他人合伙在饭菜中放了毒药。因此殴打妻子。除药物治疗外要注意的是
A. 说服病人放弃怀疑
B. 外出旅行、疗养
C. 防止发生意外
D. 更换工作单位
E. 请上级、同事改变对病人的态度

正确答案：C。防止发生意外

解析：中青年男性，约1年时间孤僻、寡言（抑郁症状），近期由于被上级批评后出现失眠，不上班并紧闭门窗，声称有人监视自己（典型的幻觉症状），在家中不敢谈话，说家中已被安装窃听器，公安局也要逮捕自己，不吃妻子做的饭食，认为妻子已同他人合伙在饭菜中放了毒药（典型的被害妄想症状），因此殴打妻子，根据患者的临床症状及体征，考虑最可能的诊断为精神分裂症偏执型，由于该患者是首次急性发作且存在攻击暴力，所以除药物治疗外要注意的是防止发生意外（C对），该患者应住院治疗，以免伤害到自己或他人。